女，62岁，水肿3个月，肾病综合征，病理示局灶节段性肾小球硬化，应用强的松60mg/d，影像学胸片右下肺渗出，尿蛋白2.9g/dL，RBC3～5/HP，Alb29g/L，此时最大的风险是
A. 急性肾损伤
B. 消化性溃疡
C. 肺栓塞
D. 肺部机会致病菌感染
E. 类固醇性糖尿病

正确答案：D。肺部机会致病菌感染

解析：患者目前肾病综合征诊断明确，应用糖皮质激素抑制免疫治疗，感染是肾病综合征最常见并发症，同时本例影像学胸片右下肺渗出，提示有炎症，故考虑此时最大的风险是肺部机会致病菌感染（D对）。急性肾损伤（A错）和肺栓塞（C错）也是肾病综合征的并发症，但不是最常见的。消化性溃疡（B错）和类固醇性糖尿病（E错）是应用糖皮质激素的副作用。